氰化物中毒所致的缺氧，血氧变化特点中哪项是错误的
A. 动脉血氧分压正常
B. 氧饱和度正常
C. 氧含量正常
D. 静脉血氧含量较高
E. 动-静脉氧含量差大于正常

正确答案：E。动-静脉氧含量差大于正常

解析：氰化物中毒所致的缺氧是组织性缺氧，而动脉血氧分压正常（A对）、血氧含量正常（C对）、血氧饱和度正常（B对）、静脉血氧含量高于正常（D对）和动-静脉氧含量差减少（E错，为本题正确答案）是组织性缺氧的血氧变化特点。